男性，55岁，上颌321│345678、下颌65│678缺失，戴用义齿后经常咬舌。原因是人工后牙
A. （牙合）平面偏高
B. 舌侧覆盖过大
C. 下颌后牙排列偏向舌侧
D. 牙尖斜度过小
E. 舌尖过锐

正确答案：C。下颌后牙排列偏向舌侧

解析：由于上颌后牙的覆盖过小或缺牙后，颊部软组织向内凹陷，天然牙牙尖锐利都会造成咬颊黏膜，应加大后牙覆盖，调磨过锐的牙尖，加厚基托推开颊肌。咬舌多因下颌后牙排列偏向舌侧或因平面过低造成，可适当升高下颌平面，磨除下颌人工牙的舌面或重新排列后牙。掌握“局部义齿修复后出现的问题及处理”知识点。